金银花与连翘除均能清热解毒外，还均能
A. 疏散风热
B. 通淋
C. 通络
D. 利咽
E. 排脓消痈

正确答案：A。疏散风热

解析：本题考查的是金银花和连翘的功效。金银花与连翘除均能清热解毒外，还均能疏散风热（A对）。金银花：【功效】清热解毒，疏散风热。连翘：【功效】清热解毒，疏散风热，消肿散结，利尿。蒲公英：【功效】清热解毒，消痈散结，利湿通淋（B错）。大血藤：【功效】清热解毒，活血止痛，祛风通络（C错）。大青叶：【功效】清热解毒，凉血消斑，利咽（D错）消肿。鱼腥草：【功效】清热解毒，排脓消痈（E错），利尿通淋。